下列各项，心浊音界向健侧移位，患侧心脏浊音界叩诊不清楚的是
A. 肺不张
B. 胸膜肥厚
C. 肺实变
D. 胸腔积液
E. 肺大泡

正确答案：D。胸腔积液

解析：心浊音界包括相对及绝对浊音界两部分，心脏左右缘被肺遮盖的部分，叩诊呈相对浊音，而不被肺遮盖的部分则叩诊呈绝对浊音。胸膜腔中至大量积液时推挤纵膈向健侧移位，故心浊音界向健侧移位，患侧心脏浊音界叩诊不清楚的是胸腔积液（D对）（人卫八版诊断学P148）。肺不张（A错）、胸膜肥厚（B错）因受到患侧肺组织牵拉心界移向患侧。肺实变（C错）、肺大泡（E错）心界居中。